女，35岁。餐后突起上腹持续性疼痛，呕吐8h，查体：脉搏116次/分，收缩压68mmHg，上腹有压痛，肠鸣音无明显异常，WBC：14×10⁹/L，尿淀粉酶526U。最可能的诊断是
A. 溃疡病穿孔
B. 急性胰腺炎
C. 胆囊结石
D. 急性胃炎
E. 急性胆囊炎

正确答案：B。急性胰腺炎

解析：患者餐后突起上腹持续性疼痛、呕吐8h、脉搏116次/分、收缩压68mmHg、上腹压痛、WBC：14×10⁹/L（白细胞计数升高）、尿淀粉酶526U（尿淀粉酶显著升高），可诊断为急性胰腺炎（B对）。溃疡病穿孔（A错）、胆囊结石（C错）、急性胃炎（D错）、急性胆囊炎（E错）均无尿淀粉酶的变化，故均不是最有可能的诊断。